尘肺X线诊断标准中“p”阴影是指
A. 直径在3～10mm以下的类圆形小阴影
B. 直径在1.5～3mm的类圆形小阴影
C. 直径在1.5mm以下的类圆形小阴影
D. 宽度在1.5mm以下的不规则形小阴影
E. 宽度在1.5mm以下的不规则形小阴影

正确答案：C。直径在1.5mm以下的类圆形小阴影

解析：本题考查p阴影。p阴影属于圆形小阴影的一类，其直径﹤1.5mm（C对ABDE错）。